亚慢性毒性试验观察指标不包括
A. 食物利用率
B. 脏器系数
C. 血生化学检查
D. 红细胞中的微核
E. 病理学检查

正确答案：D。红细胞中的微核